热射病的发病机制为
A. 水、电解质代谢紊乱
B. 大量失水引起循环血量减少，热引起外周血管扩张
C. 太阳照射头部过度受热，脑组织受热充血
D. 机体产热与获热>散热，引起体内蓄热，使体内温度不断升高所致
E. 大量出汗，致失水过多

正确答案：D。机体产热与获热>散热，引起体内蓄热，使体内温度不断升高所致